在DIC病理过程的晚期发生明显出血时，体内
A. 凝血系统的活性远大于纤溶系统活性
B. 纤溶系统的活性大于凝血系统的活性
C. 激肽系统被激活
D. 凝血系统被激活
E. 纤溶系统被激活

正确答案：B。纤溶系统的活性大于凝血系统的活性

解析：纤溶系统的活性大于凝血系统的活性（B对ACDE错）出现在DIC病理过程的晚期发生明显出血时，DIC时产生的大量凝血酶及 F XIIa 等激活了纤溶系统，产生大量纤溶酶，导致纤溶亢进和 FDP的形成 。此期出血十分明显。